不属于臂丛分支的是
A. 尺神经
B. 桡神经
C. 正中神经
D. 膈神经
E. 肌皮神经

正确答案：D。膈神经

解析：臂丛分为锁骨上分支和锁骨下分支，锁骨上分支包括胸长神经、肩胛背神经、肩胛上神经，锁骨下分支包括肩胛下神经、胸内侧神经、胸外侧神经、胸背神经、腋神经、肌皮神经、正中神经（C对）、尺神经（A对）、桡神经（B对）、臂内侧皮神经、前臂内侧皮神经。膈神经（D错，为本题正确选项）为颈丛的分支。